龟甲的功效有
A. 滋阴潜阳
B. 益肾健骨
C. 清退虚热
D. 养血补心
E. 凉血止血

正确答案：A、B、D、E。滋阴潜阳；益肾健骨；养血补心；凉血止血

解析：本题考查龟甲的功效。龟甲的功效有滋阴潜阳（A对）、益肾健骨（B对）、养血补心（D对）、凉血止血（E对）。龟甲【功效】滋阴潜阳，益肾健骨，养血补心，凉血止血。黄柏【功效】清热燥湿，泻火解毒，退虚热（C错）。